《曼谷宣言》对21世纪全球健康目标——人人享有卫生保健，提出了主要承诺，该承诺不包括
A. 使健康促进成为全球发展议程的中心
B. 使健康促进成为各国政府的一项核心责任
C. 使健康促进成为社区民间社会的一个主要重点
D. 使健康促进成为公司规范的一项基本要求
E. 使健康促进成为防范公共卫生事件的一项任务

正确答案：E。使健康促进成为防范公共卫生事件的一项任务